下列哪一项是双胍类药物治疗糖尿病的机制
A. 增强胰岛素的作用
B. 促进组织摄取葡萄糖
C. 阻滞ATP敏感的钾通道
D. 刺激内源性胰岛素的分泌
E. 增加靶细胞膜上胰岛素受体的数目

正确答案：B。促进组织摄取葡萄糖

解析：双胍类药物其作用机制可能是促进脂肪组织摄取葡萄糖，降低葡萄糖在肠的吸收及糖原异生，抑制胰高血糖素释放等。主要用于轻症糖尿病患者，尤适用于肥胖及单用饮食控制无效者。掌握“胰岛素、磺酰脲类及双胍类药”知识点。